螺内酯利尿作用的机制是
A. 作用于髓袢升支粗段的髓质和皮质部，抑制Na⁺-K⁺-2cl共同转运系统
B. 作用于髓袢升支粗段的皮质部，抑制Na⁺-Cl⁻共同转运系统
C. 作用于远曲小管和集合管，竞争醛固酮受体，对抗醛固酮的作用
D. 作用于远曲小管和集合管，阻滞Na⁺通道，减少Na⁺的重吸收
E. 作用于近曲小管，抑制碳酸酐酶，减少H⁺-Na⁺交换

正确答案：C。作用于远曲小管和集合管，竞争醛固酮受体，对抗醛固酮的作用

解析：低效利尿药又称保钾利尿药。常用药物螺内酯结构与醛固酮相似，通过竞争醛固酮受体，抑制Na⁺-K⁺交换，减少Na⁺的重吸收和K的分泌，产生留钾利尿作用。螺内酯能与远曲小管远端和集合管细胞浆内的醛固酮受体相结合，竞争性拮抗醛固酮的作用，使远曲小管和集合管的K⁺-Na⁺交换减少，具有排钠留钾的利尿作用（C对）。